可用托烷生物碱反应鉴别的是
A. 维生素B₁
B. 硫酸阿托品
C. 磺胺甲噁唑
D. 布洛芬
E. 葡萄糖

正确答案：B。硫酸阿托品

解析：本题考查托烷生物碱类的鉴别反应。Vitali鉴别反应系托烷生物碱类的特征反应。原理是阿托品（B对）、莨菪碱等莨菪烷类生物碱结构中的酯键水解后生成莨菪酸，经发烟硝酸加热处理转变为三硝基衍生物，再与氢氧化钾的醇溶液和固体氢氧化钾作用脱羧，转化成具有共轭结构的阴离子而显深紫色。